女性，55岁。丧偶8年，现独居，嗜烟酒，不爱运动。平时性情抑郁，过分容忍，办事无主见，常顺从于别人。1月前行胃癌切除，术中及术后情绪低落，兴趣下降，常独自流泪，有轻生之念。患者病前的行为特征为
A. A型
B. B型
C. C型
D. 混合型
E. 以上都不是

正确答案：C。C型